下列关于嵌体蜡型的描述，哪项是错误的
A. 蜡型又称蜡模
B. 蜡型可以用自凝塑料制作
C. 蜡型可以用热凝塑料制作
D. 蜡型可以用塑料蜡制作
E. 蜡型可以用铸造蜡制作

正确答案：C。蜡型可以用热凝塑料制作

解析：本题考查嵌体蜡型。关于嵌体蜡型的描述错误的是蜡型可以用热凝塑料制作（C错，为本题的正确答案）。蜡型又称蜡模（A对），主要有基托蜡、铸造蜡、嵌体蜡、合成树脂蜡。蜡型可以用自凝塑料制作（B对）、可以用塑料蜡制作（D对）、也可以用铸造蜡制作（E对）。但由于蜡的熔化温度的限制，不能用热凝塑料制作。